涎腺恶性多形性腺瘤不包括
A. 癌肉瘤
B. 转移性多形性腺瘤
C. 转移癌
D. 浸润癌
E. 原位癌

正确答案：C。转移癌

解析：根据WHO肿瘤国际组织学分类中心讨论结果，涎腺恶性多形性腺瘤分为：①原位癌（非侵袭性癌）：仅见局限性恶性病变区，未浸润周围组织。②侵袭性癌：浸润周围组织。③癌肉瘤（真性恶性混合瘤）：具有癌和肉瘤结构。④转移性良性多形性腺瘤：原发瘤和转移瘤均为良性。掌握“基底细胞腺瘤及恶性多形性腺瘤”知识点。